与队列研究相比，病例对照研究的优点是
A. 更容易避免系统误差
B. 更容易确定暴露与疾病的先后顺序
C. 更适用于罕见病的病因研究
D. 更容易验证病因假设
E. 可以直接计算发病率指标

正确答案：C。更适用于罕见病的病因研究

解析：本题考查病例对照研究的特点。与队列研究相比，病例对照研究的优点是：1.特别适用于罕见病、潜伏期长疾病的病因研究（C对ABDE错），有时往往是罕见病病因研究的唯一选择；2.相对更节省人力、物力、财力和时间，并且较易于组织实施；3.可以同时研究多个暴露与某种疾病的联系，特别适合于探索性病因研究；4.应用范围广，不仅应用于病因的探讨，而且广泛应用于其他健康事件的原因分析。